顺产后4个月哺乳期女性，首选的避孕方法是
A. 紧急避孕药
B. 工具避孕
C. 复方短效口服避孕药
D. 长效复方避孕注射剂
E. 安全期避孕

正确答案：B。工具避孕

解析：若已恢复性生活，应采取避孕措施，哺乳者以工具避孕为宜，不哺乳者可选用药物避孕（B对）。紧急避孕药（A错）（P380）是无保护性生活后或避孕失败后几小时或几日内，为防止非意愿性妊娠发生而采用的补救避孕法，不是常规避孕措施。复方短效口服避孕药（P378）（C错）的主要作用为抑制排卵，正确使用避孕药的有效率接近100%，但需长期服用，没有IUD简便经济。长效复方避孕注射剂即长效避孕针（D错）（P378），有单孕激素制剂和雌、孕激素复合制剂两种；复合制剂由于激素剂量大，副作用大，很少用；单孕激素制剂对乳汁的质和量影响小，较适用于哺乳期妇女，但需定期注射，在我国应手不如IUD广泛。安全期避孕（P381）（E错）又称自然避孕，并不十分可靠，不宜推广。